“善诊者，察色案脉，先别阴阳”出自
A. 《素问·生气通天论》
B. 《素问·至真要大论》
C. 《素问·咳论》
D. 《素问·痹论》
E. 《素问·阴阳应象大论》

正确答案：E。《素问·阴阳应象大论》

解析：“善诊者，察色按脉，先别阴阳”即善于诊治疾病的医生，在诊治疾病时，一定要四诊合参，先辨疾病的阴阳属性，出自《素问·阴阳应象大论》（E对）。